不符合小儿生长发育的一般规律的是
A. 由上到下
B. 由远到近
C. 由粗到细
D. 由低级到高级
E. 由简单到复杂

正确答案：B。由远到近

解析：小儿生长发育规律遵循由上到下（A对）、由近到远（B错，为本题正确答案）、由粗到细（C对）、由低级到高级（D对）、由简单到复杂（E对）。